特别适于小儿的针具
A. 毫针
B. 芒针
C. 三棱针
D. 皮肤针
E. 皮内针

正确答案：D。皮肤针

解析：本题考查中医针具的使用。特别适于小儿的针具是皮肤针（D对）。皮肤针疗法是多针浅刺的一种方法，由于针刺仅深及皮肤，所以又称“皮刺疗法”。按其工具的形式及针数的多少，可分为七星针、梅花针和丛针等。这种针具针刺时，一般疼痛较轻微，尤适用于小儿，故又称“小儿针”。目前毫针（A错）刺法在临床广泛用于：中风、偏头痛、三叉神经痛、支气管哮喘、急慢性支气管炎、胃下垂等。芒针（B错）适应症颇多，主要用于多发性神经炎、脊髓侧索硬化、风湿及类风湿性关节炎、颈椎综合征、半身不遂、面神经麻痹、截瘫、胃下垂、子宫下垂、脊髓空洞症、阳萎、精神病、癫痫、前列腺炎、高血压、支气管炎、颈椎病等。三棱针（C错）：用于点刺放血的针具，用它刺破患者身体上的一定穴位或浅表血络，放出少量血液，以治疗疾病的方法称刺络法。亦称为“刺血络”。皮内针（E错）：皮内针疗法适用于神经性头痛、偏头痛、胃痛、胆绞痛、胁痛、腕踝关节扭伤等。